女性，18岁。1年来逐渐面色苍白，无力，检查：血红蛋白50g/L，白细胞5.0×10⁹/L，血清铁400ug/L，最可能的诊断是
A. 感染性贫血
B. 巨幼细胞性贫血
C. 缺铁性贫血
D. 再生障碍性贫血
E. 溶血性贫血

正确答案：C。缺铁性贫血

解析：患者青年女性（缺铁性贫血的好发人群），面色苍白、无力（贫血的表现），血红蛋白50g/L（成年女性正常值Hb＞110g/L）提示贫血，白细胞5.0×10⁹/L（正常4～10×10⁹/L），血清铁400μg/L降低（缺铁性贫血时，血清铁低于8.95μmol/L），故最可能的诊断是缺铁性贫血（C对）。感染性贫血（A错）是指感染性疾病引起的贫血，常有发热、肝脾大等原发感染的表现，血白细胞计数增高；巨幼细胞性贫血（P545）（B错）是由于叶酸或维生素B₁₂缺乏引起的贫血，实验室检查可有血清叶酸或维生素B₁₂减少，血清铁正常；再生障碍性贫血（P548）（D错）表现为全血细胞减少，白细胞计数多＜2×10⁹/L；溶血性贫血（P552）（E错）常表现为贫血、黄疸、肝大，实验室检查常有胆红素升高，血清铁正常。